患者，男，40岁。有消渴病史。项后发际处多个红色结块，灼热疼痛，溃脓后愈合，但不久又发，经年难愈。其诊断是
A. 痈
B. 疔疮
C. 暑疖
D. 疖病
E. 有头疽

正确答案：D。疖病

解析：痈是发生于体表皮肉之间的急性化脓性疾病，其特点为局部光软无头，红肿疼痛，少数可皮色不变，结块多在6~9cm左右，颈痈可发于项后，初起局部肿胀、灼热、疼痛，具有明显的风温症状。溃后脓出黄白稠厚，肿退痛消，约10~14天左右可愈合，一般不反复发作，病因多为外感风温、风热之邪或内伤情志，气郁化火，或喜食辛辣、膏粱厚味，痰热内生，或因换乳蛾、口疳、头面疮疖毒邪流窜至颈部（A错）。疔疮是一种发病迅速，易于变化而危险性较大的化脓性疾病，多发于颜面、手足部位，其特点为疮形虽小，但根脚坚硬，有如钉丁之状，病情变化迅速，容易造成毒邪走散，发生走黄、筋骨损伤等（B错）。暑疖是指夏季发生的化脓性疖肿（C错）。疖病好发于项后发际、背部、臀部，几个到几十个，反复发作，缠绵不愈，也可在身体各出散发疖肿，一处将愈，他处续发，或间隔周余、月余再发，患消渴病者易患本病，疖肿势多局限，多小于3cm，突起根浅，色红、灼热、疼痛，题中患者符合疖病的临床表现（D对）。有头疽是发生于肌肤间的急性化脓性疾病，其特点是初起皮肤上即有粟粒样脓头，焮热红肿胀痛，迅速向深部及周围扩散，脓头相继增多，溃烂后状如莲蓬、蜂窝，范围常超过9~12cm，大者可在30cm以上，好发于项后、背部等皮肤厚韧之处，多见于中老年人及消渴患者，容易发生内陷，题中无脓头，无扩散（E错）。